临床上静脉穿刺，常选静脉不包括
A. 头静脉
B. 贵要静脉
C. 大隐静脉
D. 肘正中静脉
E. 颈内静脉

正确答案：E。颈内静脉

解析：头静脉（A对）、贵要静脉（B对）、肘正中静脉（D对）为上肢浅静脉，常用于取血、输液和注射药物。大隐静脉（C对）为下肢浅静脉，是输液和注射的常用部位。颈内静脉（E错，为本题正确答案）内血液容易回流，静脉穿刺时导致空气栓塞，故临床上常不做静脉穿刺。